二氧化硅在化学上是种
A. 单质
B. 化合物
C. 混合物
D. 矿物质
E. 石英石

正确答案：B。化合物